可引起甲状腺功能紊乱的抗心律失常药物是
A. 维拉帕米
B. 胺碘酮
C. 普罗帕酮
D. 普鲁卡因胺
E. 奎尼丁

正确答案：B。胺碘酮

解析：胺碘酮（B对）为广谱抗心律失常药，对各型期前收缩、室上性心动过速、室性心动过速、房扑、房颤、预激综合征所致的房室折返性心动过速等有较好的疗效，长期服用可引起甲状腺功能亢进或低下。维拉帕米（A错）属于钙离子通道阻滞剂，是治疗室上性和房室结折返引起的心律失常效果好，为阵发性室上性心动过速治疗的首选药，静脉注射过快或剂量过大可引起心动过缓、房室传导阻滞甚至心脏停搏，也可引起血压下降，诱发心力衰竭。普罗帕酮（C错）适用于室上性、室性期前收缩，伴有心动过速的预激综合征，主要不良反应有胃肠道反应，还可引起房室传导阻滞与体位性低血压、加重充血性心衰，其减慢传导易致折返，引起快速型心律失常。普鲁卡因胺（D错）临床主要用于室性心律失常，可作为奎尼丁的替代药，静脉给药可引起低血压，剂量过大可引起传导阻滞和室性心律失常，长期使用少数患者可出现系统性红斑狼疮样综合征。奎尼丁（E错）为广谱的抗心律失常药，安全范围小，常见的不良反应主要有胃肠道反应、心血管反应、金鸡纳反应和过敏反应。